VZV侵犯的主要细胞是
A. 上皮细胞
B. 神经细胞
C. 白细胞
D. 巨噬细胞
E. B细胞

正确答案：A。上皮细胞

解析：水痘-带状疱疹病毒（VZV）只有一个血清型。人是VZV的唯一自然宿主，皮肤是病毒的主要靶细胞。掌握“疱疹病毒”知识点。